女性，65岁。近一年来大便次数增多、伴腹泻，腹泻便秘交替出现，偶有血便，一天前突发上腹部疼痛，呈阵发性加重，伴恶心、无呕吐，查体：体温37.5℃，血压100/70mmHg，上腹正中可触及一大小约5cm包块，全腹轻压痛，无反跳痛、无肌紧张。患者最可能的病变部位是
A. 胰体尾
B. 横结肠
C. 肝左叶
D. 胃窦部小弯侧
E. 十二指肠

正确答案：B。横结肠

解析：老年女性患者，排便次数增多、腹泻、便秘、便中带血（结直肠癌常见症状），上腹部疼痛，呈阵发性加重，上腹正中可触及一大小约5cm包块，最可能的诊断为横结肠癌。患者最可能的病变部位是横结肠（B对）。